患儿男，2岁。发热3天，咳嗽伴轻度喘息。查体：咽稍充血，呼吸稍促，双肺可闻及散在中、细湿啰音，心率116次/分，律齐，心音有力，腹软，肝脾未触及，最可能的诊断是
A. 上呼吸道感染
B. 支气管炎
C. 毛细支气管炎
D. 支气管肺炎
E. 腺病毒肺炎

正确答案：D。支气管肺炎